息风止痉药的主要归经是
A. 心经
B. 肝经
C. 二者均是
D. 二者均不是

正确答案：B。肝经

解析：本题考查的是平肝息风药的归经。息风止痉药的主要归经是肝经（B对）。凡以平抑肝阳、息风止痉为主要功效的药物，称为平肝息风药。本类药皆入肝经，多为介类或虫类药，古有介类潜阳、虫类搜风之说。具有平肝潜阳、息风止痉及镇惊安神等作用。按其性能功效及临床应用，常将本类药物分为平抑肝阳药和息风止痉药两类。主入心经（A错）的有开窍药。凡具辛香走窜之性，以开窍醒神为主要功效的药物，称为开窍药。本类药辛香行散，性善走窜，主入心经，功能通闭开窍、苏醒神志。